某男，68岁。患高血压病5年，冠心病1年，服用西药血压控制尚平稳。近1月时有头痛头胀、面红目赤、心烦易怒，舌红、苔少、脉细弦。证属阴虚阳亢。处方：天麻9g，钩藤12g（后下），石决明20g（先煎），生牡蛎30g（先煎），栀子6g，生白芍12g，炒杜仲12g，车前子15g（包煎），菊花12g，川芎10g，牛膝12g。上述方中既平肝潜阳，又益阴的药组是
A. 石决明、生牡蛎
B. 石决明、栀子
C. 生牡蛎、川芎
D. 生白芍、天麻
E. 生白芍、炒杜仲

正确答案：A。石决明、生牡蛎

解析：本题考查石决明、生牡蛎的功效。方中既平肝潜阳，又益阴的药组是石决明、生牡蛎（A对）。石决明【功效】平肝潜阳，清肝明目。牡蛎【功效】平肝潜阳，镇惊安神，软坚散结，收敛固涩，制酸止痛。栀子（B错）【功效】泻火除烦，清热利尿，凉血解毒，消肿止痛。川芎（C错）【功效】活血行气，祛风止痛。生白芍【功效】养血调经，敛阴止汗，柔肝止痛，平抑肝阳。天麻（D错）【功效】息风止痉，平抑肝阳，祛风通络。炒杜仲（E错）【功效】补肝肾，强筋骨，安胎。